智商同为85，其一是山区农民，结合他受教育程度和所处环境，考虑其智力基本正常，其二是某大学教授，结合其他表现，考虑有大脑退行性改变的可能，这是遵循心理测验的
A. 标准化原则
B. 保密性原则
C. 客观性原则
D. 统一性原则
E. 以上都不是

正确答案：C。客观性原则

解析：心理测验的原则有标准化原则、保密原则、客观性原则。客观性原则（C对），是对结果的解释要符合受试者的实际情况。如两个被试智力测验的结果，智商都是85，一个受试者是山区农民，结合他所受教育程度和生活环境等条件，可考虑他的智力水平基本上是正常的：而另一个是某大学教授，测量时严格遵守了测验的要求，结合其他的表现则考虑到该人的大脑有退行性改变的可能。标准化原则（A错）是指测量应采用公认的标准化的工具，施测方法要严格根据测验指导手册的规定执行。保密原则（B错）是指，关于测验的内容、答案及记分方法只有作此项工作的有关人员才能掌握，不允许随意扩散，更不允许在出版物上公开发表。